能行气、燥湿、消食的药是
A. 木香
B. 佛手
C. 橘红
D. 枳壳
E. 化橘红

正确答案：E。化橘红

解析：本题考查的是化橘红的功效。能行气、燥湿、消食的药是化橘红（E对）。化橘红：【功效】理气宽中，燥湿化痰，消食。木香（A错）：【功效】行气止痛，健脾消食。佛手（B错）：【功效】疏肝理气，和中，化痰。橘红（C错）：【功效】行气宽中，燥湿化痰，发表散寒。枳壳（D错）：【功效】理气宽中，行滞消胀。